静息状态下，可无明显临床表现的结石是
A. 输尿管结石
B. 膀胱结石
C. 尿路结石
D. 肾盂结石
E. 胆管结石

正确答案：D。肾盂结石

解析：静息状态下，可无明显临床表现的结石是肾盂（D对）及肾盏结石。输尿管结石（A错）典型表现为肾绞痛或输尿管绞痛。膀胱结石（B错）的典型症状为排尿突然中断，疼痛放射至远端尿道及阴茎头部，伴排尿困难和膀胱刺激症状。尿路结石（C错）是肾结石、输尿管结石、膀胱结石和尿道结石的总称，不同部位的尿路结石可出现不同的表现。胆管结石（E错）当结石造成胆管梗阻时可出现腹痛或黄疸，继发胆管炎。